具有溶解血栓作用的药物是
A. 华法林
B. 肝素
C. 链激酶
D. 维生素B₁₂
E. 双嘧达莫

正确答案：C。链激酶

解析：本题考查链霉素。链激酶（C对）可促使纤溶酶原激活形成纤溶酶，溶解血栓。华法林（A错）为维生素K拮抗剂类抗凝血药。肝素（B错）具有抗凝作用。维生素B₁₂（D错）适用于巨幼红细胞性贫血、神经炎、口炎性腹泻等一系列疾病。双嘧达莫（E错）主要用于缺血性心脏病、血栓栓塞性疾病、心肌缺血的诊断实验。